狼疮性肾炎诱导期治疗中，以下免疫抑制剂中首选的是
A. 硫唑嘌呤
B. 甲氨蝶呤
C. 环磷酰胺
D. 来氟米特
E. 雷公藤

正确答案：C。环磷酰胺

解析：狼疮肾炎是系统性红斑狼疮（SLE）的肾脏损害。约50%以上SLE病人有肾脏损害的临床表现，肾活检则显示肾脏受累几乎为100％。狼疮肾炎是我国终末期肾衰竭的重要原因之一。狼疮肾炎的治疗方案以控制病情活动、阻止肾脏病变进展为主要目的。应根据临床表现、病理特征及疾病活动程度制定个体化治疗方案。狼疮肾炎病情活动者应给与诱导疗法，待病情稳定后转入维持治疗。诱导治疗一般为泼尼松1mg/（kg·d），疗程4～6周，以控制炎症反应，此后逐渐减量，直至5～10mg/d维持；同时合用免疫抑制治疗，如环磷酰胺静脉疗法（C对），或者吗替麦考酚酯。硫唑嘌呤、甲氨蝶呤、来氟米特、雷公藤均为常用免疫抑制剂，但不作为首选（ABDE错）。